Testis睾丸
A. 为男性生殖腺
B. 呈新月形
C. 分泌物是精液的主要组成部分
D. 是囊袋状结构
E. 无

正确答案：A。为男性生殖腺

解析：睾丸为男性的生殖腺（A对）。呈新月形（B错）的结构为附睾。分泌物是精液的主要组成部分（C错）的为前列腺。是囊袋状结构（D错）的为阴囊，睾丸呈微扁的卵圆形。